罗格列酮可能导致的不良反应是
A. 体重减轻
B. 腹胀、肠鸣音亢进
C. 肝功异常和水肿
D. 白细胞计数减少
E. 红人综合征

正确答案：C、D。肝功异常和水肿；白细胞计数减少

解析：本题考查罗格列酮的不良反应。罗格列酮单药治疗或与其它降糖药合用时可见血红蛋白和血细胞比容下降，轻度白细胞计数减少（D对），罕见肝功能异常（C对），体重增加（A错）。腹胀和肠鸣音亢进（B错）为阿卡波糖的不良反应。红人综合征（E错）为万古霉素和利福平等药物导致。